关于肿瘤免疫的正确描述是
A. 肿瘤抗原只存在于细胞表面
B. 血清中抗甲胎蛋白抗体水平增高有助于原发性肝癌诊断
C. 血清中癌胚抗原水平增高有助于结肠癌诊断
D. 同种类型的肿瘤表达的肿瘤抗原相同
E. HIV与成人T淋巴细胞白血病的发病有关

正确答案：C。血清中癌胚抗原水平增高有助于结肠癌诊断